患儿，3岁。体重14kg，身长86cm。该患儿的生长发育状况为
A. 体重正常，身长偏高
B. 体重正常，身长偏低
C. 体重偏高，身长正常
D. 体重偏高，身长偏低
E. 体重偏低，身长正常

正确答案：B。体重正常，身长偏低

解析：正常3岁小儿根据公式推算身长应为91cm,14kg,患儿体重14kg，身长86cm，体重正常，身长偏低（B对）。A选项身长偏高错误（A错）。C选项体重偏高，身长正常错误（C错）。D选项体重偏高有误（D错）。E选项体重偏低，身长正常有误（E错）。